与乙醇合用而效力降低的药物是
A. 氯化钙
B. 苯巴比妥
C. 布洛芬
D. 洋地黄毒苷
E. 别嘌呤醇

正确答案：E。别嘌呤醇

解析：本题考查服用药品的特殊提示。别嘌呤醇（E对）是抗痛风药，能够抑制尿酸生成，而乙醇会抑制尿酸排泄，同时还会促进嘌呤生成，使别嘌呤醇的效果下降。